慢性病三级预防的二级预防中三早为
A. 早发现、早报告、早治疗
B. 早发现、早隔离、早诊断
C. 早发现、早报告、早康复
D. 早发现、早诊断、早治疗

正确答案：D。早发现、早诊断、早治疗

解析：本题考查二级预防。慢性病三级预防的二级预防中三早为早发现、早诊断、早治疗（D对ABC错）。